早期教育主要应在什么时候进行
A. 婴儿期
B. 幼儿期
C. 学龄前期
D. 学龄期
E. 青春期

正确答案：B。幼儿期

解析：本题考查早期教育的相关内容。早期教育是由成人主要对幼儿期（B对ACDE错）实施的教育，这是人生的启蒙教育，具有奠基的意义。